2005年11月13号，中石油吉林石化分公司一工厂爆炸引发的松花江水污染，其主要的污染物质是
A. 苯系化合物
B. 酚类
C. 镉
D. 氰化物
E. 汞

正确答案：A。苯系化合物

解析：本题考查水体污染的相关内容。2005年11月13号，中石油吉林石化分公司一工厂爆炸引发的松花江水污染，其主要的污染物质是苯系化合物（A对BCDE错）。